在孕期或分娩期，HBV从母体传给子代称为
A. 血源性传播
B. 遗传性传播
C. 垂直传播
D. 水平传播
E. 围产期传播

正确答案：C。垂直传播

解析：本题考查乙型肝炎的传播途径。乙肝病毒的传播途径之一是母婴传播，也称垂直传播（C对ABDE错），也就是由于母亲是乙肝病毒携带者，在怀孕、分娩时未采取措施，而使婴儿一出生即被感染乙肝病毒。